梅毒黏膜斑处于梅毒第几期
A. 一期梅毒
B. 二期梅毒
C. 三期梅毒
D. 早期梅毒
E. 晚期梅毒

正确答案：B。二期梅毒

解析：本题考查梅毒的临床表现。梅毒黏膜斑处于梅毒第二期（B对）。一期梅毒（A错）主要表现为硬下暗和淋巴结肿大，一般无全身症状。二期梅毒最常见的口腔损害是黏膜斑，可发生在口腔黏膜的任何部位。三期梅毒（C错）也称晚期梅毒（E错），此期皮肤损害主要为结节性梅毒疹和树胶肿。一期梅毒和二期梅毒为早期梅毒（D错）。